下列不属于社会经济发展对健康负面影响的选项是
A. 环境污染和破坏
B. 不良行为和心理压力
C. 交通事故增多
D. 传染性疾病发病率下降
E. 社会流动人口增加

正确答案：D。传染性疾病发病率下降